口腔颌面部癌与肉瘤的根本区别是
A. 组织学来源
B. 发病年龄
C. 生长方式
D. 临床症状
E. 对全身的影响

正确答案：A。组织学来源

解析：本题考查口腔颌面部癌与肉瘤的根本区别。癌与肉瘤在组织学来源、发病年龄、发病率、转移途径等方面区别。在组织学来源方面，癌来自上皮组织，肉瘤来自间叶组织，这是两者最根本的区别（A对）。从发病年龄来讲，癌好发于40岁以上的成年人，肉瘤多见于青少年（B错）；癌较常见，发病率高，约为肉瘤的9倍；癌常发生淋巴结转移，肉瘤多经血道转移。两者的生长方式均为浸润性生长（C错）；两者都可引起局部疼痛，麻木，头痛，张口受限，面瘫，出血等临床症状（D错）；两者对全身的影响很大，常因迅速发展、转移和侵及重要脏器及发生恶病质，导致死亡（E错）。